前列腺癌（T₁b、T₂期）的最佳治疗方法是
A. 应用促黄体释放激素类似物（LHRH-A）
B. 睾丸切除
C. 根治性前列腺切除
D. 抗雄激素治疗
E. 化疗

正确答案：C。根治性前列腺切除

解析：前列腺癌的治疗方法与其临床分期密切相关：①T1a期，一般病灶小，细胞分化好可以不作处理，严密观察随诊；②局限在包膜内的T1b、T2期癌可以行根治性前列腺切除术（C对），也是治疗前列腺癌的最佳方法；③T3、T4期癌以内分泌治疗为主，可以行去势治疗（双侧睾丸切除（B错）或药物去势，药物去势的方法为每月皮下注射一次促黄体释放激素类似物（A错）缓释剂），配合抗雄激素（D错）制剂间歇治疗以提高生存率；④化疗（E错）适用于内分泌治疗失败的病人。